可使舌伸长的肌肉是
A. 舌上纵肌和舌下纵肌
B. 舌横肌
C. 舌垂直肌
D. 颏舌肌
E. 舌骨舌肌

正确答案：B。舌横肌

解析：舌横肌收缩时使舌伸长。掌握“表情肌、舌腭肌”知识点。